属于M受体拮抗剂，因分子中含有季铵基团，不能通过血脑屏障，而没有中枢神经系统副作用的抗尿失禁药物是
A. 曲司氯铵
B. 盐酸奥昔布宁
C. 甲磺酸酚胺拉明
D. 盐酸伐地那非
E. 盐酸哌唑嗪

正确答案：A。曲司氯铵

解析：本题考查曲司氯铵的结构和药理作用。曲司氯铵（A对）属于M受体拮抗剂，分子中含有季铵基团，不能通过血脑屏障，无中枢神经系统副作用。